主含生物碱类化学成分的药材有
A. 当归
B. 苦参
C. 麻黄
D. 川乌
E. 五味子

正确答案：B、C、D。苦参；麻黄；川乌

解析：本题考查的是含生物碱类化合物的常用中药。主含生物碱类化学成分的药材有苦参（B对）、麻黄（C对）、川乌（D对）。苦参所含主要生物碱是苦参碱和氧化苦参碱。麻黄中含有多种生物碱，以麻黄碱和伪麻黄碱为主。乌头和附子主要含二萜类生物碱，属于四环或五环二萜类衍生物。当归（A错）中主要含有有机酸类成分、挥发油和多糖类成分。有机酸类成分主要包括阿魏酸、香草酸、烟酸和琥珀酸等。五味子（E错）中含木脂素较多，约为5%，近年来从其果实中分得了一系列联苯环辛烯型木脂素，包括五味子醇和五味子素。